植物类药材显微鉴定时，加10%α-萘酚乙醇溶液，再加硫酸，显紫红色并溶解的后含物是
A. 糊粉粒
B. 草酸钙结晶
C. 碳酸钙结晶
D. 菊糖
E. 硅质块

正确答案：D。菊糖

解析：本题考查的是细胞内含物的鉴定方法。植物类药材显微鉴定时，加10%α-萘酚乙醇溶液，再加硫酸，显紫红色并溶解的后含物是菊糖（D对）。细胞内含物的鉴定：①淀粉粒：加碘试液，显蓝色或紫色；用醋酸甘油试液装片，置偏光显微镜观察，未糊化淀粉粒有偏光现象；已糊化的无偏光现象。②糊粉粒（A错）：加碘试液，显棕色或黄棕色；加硝酸汞试液显砖红色。③脂肪油、挥发油或树脂：加苏丹Ⅲ试液呈橘红色、红色或紫红色；加90%乙醇，脂肪油不溶解，挥发油则溶解。④菊糖：加10%α-萘酚乙醇溶液，再加硫酸，呈紫红色并很快溶解。⑤黏液：加钌红试液，显红色。⑥草酸钙结晶（B错）：加稀醋酸不溶解，加稀盐酸溶解而无气泡产生；加硫酸溶液（1→2），逐渐溶解，片刻后析出针状硫酸钙结晶。⑦碳酸钙结晶（C错）（钟乳体）：加稀盐酸溶解，同时有气泡产生。⑧硅质（E错）：加硫酸不溶解。